女性，58岁。2型糖尿病15年，长期口服格列本脲，10mg/日。查体：血压145/90mmHg，心肺和腹部检查未见异常，双下肢无水肿。眼底检查，视网膜病变Ⅲ期。空腹血糖6.8mmol/L，餐后2小时血糖10.6mmol/L，血尿素氮6.2mmol/L，血肌酐92.8μmol/L，尿常规检查尿糖50mmol/L，蛋白阴性。为排除糖尿病肾病，最需要的实验室检查是
A. 尿酸化功能试验
B. 尿相差显微镜检
C. 肌酐清除率
D. 尿微量白蛋白
E. 24小时尿蛋白定量

正确答案：D。尿微量白蛋白

解析：中老年女性患者，2型糖尿病15年病史，出现视网膜病变说明糖尿病累及到微血管，此时应进一步排查有无并发糖尿病肾病，糖尿病肾病早期尿蛋白可阴性，但微量白蛋白高于正常值，因此为排除糖尿病肾病，可进行尿微量白蛋白检查（D对）。尿酸化功能试验（A错）主要用于肾小管性酸中毒的辅助检查。尿相差显微镜检（B错）主要用于鉴别肾小球源性与非肾小球源性血尿。肌酐清除率（C错）在糖尿病肾病早期可正常。24小时尿蛋白定量（E错）多用于肾病综合征的诊断，糖尿病肾病早期尿蛋白可不升高。